男，12岁。10天前出现上唇部红肿，可见脓头，自行挤压排脓液，后出现发热、畏寒，体温最高达38.9度，寒战，头痛剧烈，神志不清，其可能的并发症是
A. 颌下淋巴结炎
B. 眼眶内感染
C. 海绵状静脉窦炎
D. 面部蜂窝织炎
E. 化脓性上颌窦炎

正确答案：C。海绵状静脉窦炎

解析：患者10天前上唇部红肿、见脓头，挤压排脓后出现畏寒发热，寒战、高热，头痛，神志不清等感染症状，应考虑为面疖引发的海绵状静脉窦炎。危险三角区（鼻、上唇及其周围）的面疖严禁挤压，否则挤压后病菌可经内眦静脉、眼静脉（面部静脉无静脉瓣）进入颅内海绵状静脉窦，引起化脓性海绵状静脉窦炎（C对），表现为寒战、高热、头痛、呕吐、昏迷等。颌下淋巴结炎（A错）多表现为颌下淋巴结的肿大、触痛。面疖造成眼眶内感染少见（B错）。面部蜂窝织炎表现为面部肿胀疼痛、表皮发红、边界不清，病人常有畏寒发热，但无头痛、昏迷等颅内感染症状（D错）。化脓性上颌窦炎常继发于鼻腔内感染（E错）。